输血时主要考虑
A. 给血者红细胞不被受血者细胞所凝集
B. 给血者红细胞不被受血者血清所凝集
C. 给血者血浆不使受血者血浆发生凝集
D. 给血者血浆不使受血者红细胞凝集
E. 受血者红细胞不与其血浆发生凝集

正确答案：B。给血者红细胞不被受血者血清所凝集